下面关于内侧丘系的说法何者正确
A. 是第一级传入纤维组成
B. 其细胞体位于后角内
C. 其纤维止于丘脑内侧核
D. 是由对侧的楔束核和薄束核发出的纤维组成
E. 仅传递深部感觉冲动

正确答案：D。是由对侧的楔束核和薄束核发出的纤维组成

解析：内侧丘系是躯干和四肢意识性本体感觉和精细触觉传导通路中的纤维之一。躯干和四肢意识性本体感觉和精细触觉传导通路的第2级神经元胞体在薄、楔束核内（B错），由此2核发出的纤维向前绕过中央灰质的腹侧，在中线上与对侧的交叉，称内侧丘系交叉，即由对侧的楔束核和薄束核发出的纤维组成（D对），交叉后的纤维转折向上，在锥体束的背侧呈前后方向排列，行于延髓中线两侧，称内侧丘系，终于同侧丘脑腹后核（C错）。